断面显层叠状的药材是
A. 石膏
B. 信石
C. 朱砂
D. 赭石
E. 雄黄

正确答案：D。赭石

解析：本题考查的是赭石药材的性状鉴别。断面显层叠状的药材是赭石（D对）。赭石：【性状鉴别】药材为鲕状、豆状、肾状集合体。多呈不规则的扁平块状。暗棕红色或灰黑色，条痕樱红色或红棕色，有的有金属光泽。一面多有圆形的突起，习称“钉头”；另一面与突起相对应处有同样大小的凹窝。体重，质硬，砸碎后断面显层叠状。气微，味淡。石膏（A错）：【性状鉴别】药材为纤维状的集合体。呈长块状、板块状或不规则块状。白色、灰白色或淡黄色，有的半透明。体重，质软，纵断面具绢丝样光泽。气微，味淡。朱砂（C错）：【性状鉴别】药材为粒状或块状集合体，呈颗粒状或块片状。鲜红色或暗红色，条痕红色至褐红色，具光泽。体重，质脆，片状者易破碎，粉末状者有闪烁的光泽。气微，味淡。雄黄（E错）：【性状鉴别】药材为块状或粒状集合体，呈不规则块状。深红色或橙红色，条痕淡橘红色，晶面有金刚石样光泽。质脆，易碎，断面具树脂样光泽。微有特异臭气，味淡。精矿粉为粉末状或粉末集合体，质松脆，手捏即成粉，橙黄色，无光泽。信石（B错）药材的性状鉴别，2022年考试指南未明确说明。